某女，65岁，时发水泻，历时3年就诊是正值盛暑，每日水泻3～4次，伴倦怠乏力，畏寒肢冷，舌质淡，苔白水滑，脉沉。医师诊为脾虚水湿不运之泄泻，处方为炒白术、茯苓、猪苓、炒泽泻、陈皮、炒车前子、炒山药，水煎服。服药5剂，水泻遂止，倦怠乏力、畏寒肢冷有所改善。医师在处方中选用炒车前子，是因其既能利水，又能
A. 燥湿止泻
B. 健脾止泻
C. 渗湿止泻
D. 固肾止泻
E. 涩肠止泻

正确答案：C。渗湿止泻

解析：本题考查的是车前子的功效。医师在处方中选用炒车前子，是因其既能利水，又能渗湿止泻（C对）。车前子：【功效】利水通淋，渗湿止泻，明目，清肺化痰。吴茱萸：【功效】散寒止痛，疏肝下气，燥湿止泻（A错）。薏苡仁：【功效】利水渗湿，健脾止泻（B错），除痹，清热排脓。赤石脂：【功效】涩肠止（E错）泻，止血，止带；外用收湿敛疮生肌。功能为固肾止泻（D错）的中药，2022年考试指南未明确说明。